乙型血友病（血友病B）需定期补充的凝血因子是
A. 人凝血因子Ⅱ
B. 人凝血因子Ⅸ
C. 人凝血因子Ⅹ
D. 人凝血因子Ⅶ
E. 人凝血因子Ⅷ

正确答案：B。人凝血因子Ⅸ

解析：本题考查凝血因子的应用。乙型血友病（血友病B）需定期补充的凝血因子是重组凝血因子Ⅸ（B对）。